关于在电视台，广播电台上发布药品广告的说法，正确的有
A. 已经审查批准的药品广告在广播电台发布时，可不播出药品广告批准文号
B. 电视台、广播电台不得发布涉及改善和增强性功能内容的药品广告
C. 只能发布非处方药药品广告，不得发布处方药药品广告
D. 针对未成年人的广播电视频道的节目、栏目，不得发布药品广告

正确答案：C、D。只能发布非处方药药品广告，不得发布处方药药品广告；针对未成年人的广播电视频道的节目、栏目，不得发布药品广告

解析：本题考查药品广告管理。关于在电视台，广播电台上发布药品广告的说法，正确的有只能发布非处方药药品广告，不得发布处方药药品广告（C对），针对未成年人的广播电视频道的节目、栏目，不得发布药品广告（D对）。广告发布媒体的限制：处方药和特殊医学用途配方食品中的特定全营养配方食品广告只能在国务院卫生健康委员会和国家药品监督管理部门共同指定的医学、药学专业刊物上发布。不得利用处方药或者特定全营养配方食品的名称为各种活动冠名进行广告宣传。不得使用与处方药名称或者特定全营养配方食品名称相同的商标、企业字号在医学、药学专业刊物以外的媒介变相发布广告，也不得利用该商标、企业字号为各种活动冠名进行广告宣传。特殊医学用途婴儿配方食品广告不得在大众传播媒介或者公共场所发布。《中华人民共和国广告法》第三章广告行为规范第四十条：在针对未成年人的大众传播媒介上不得发布医疗、药品、保健食品、医疗器械、化妆品、酒类、美容广告，以及不利于未成年人身心健康的网络游戏广告。针对不满十四周岁的未成年人的商品或者服务的广告不得含有下列内容：（一）劝诱其要求家长购买广告商品或者服务；（二）可能引发其模仿不安全行为。药品、医疗器械、保健食品和特殊医学用途配方食品广告应当显著标明广告批准文号（A错）。广告中不得出现的情形（B错）：药品、医疗器械、保健食品和特殊医学用途配方食品广告不得违反《广告法》第九条、第十六条、第十九条规定，不得包含的内容还包括：①使用或者变相使用国家机关、国家机关工作人员、军队单位或者军队人员的名义或者形象，或者利用军队装备、设施等从事广告宣传；②使用科研单位、学术机构、行业协会或者专家、学者、医师、药师、临床营养师、患者等的名义或者形象作推荐、证明；③违反科学规律，明示或者暗示可以治疗所有疾病、适应所有症状、适应所有人群，或者正常生活和治疗病症所必需等内容；④引起公众对所处健康状况和所患疾病产生不必要的担忧和恐惧，或者使公众误解不使用该产品会患某种疾病或者加重病情的内容；⑤含有“安全”“安全无毒副作用”“毒副作用小”；明示或者暗示成分为“天然”，因而安全性有保证等内容；⑥含有“热销、抢购、试用”“家庭必备、免费治疗、免费赠送”等诱导性内容，“评比、排序、推荐、指定、选用、获奖”等综合性评价内容，“无效退款、保险公司保险”等保证性内容，怂患消费者任意、过量使用药品的内容；⑦含有医疗机构的名称、地址、联系方式、诊疗项目、诊疗方法以及有关义诊、医疗咨询电话、开设特约门诊等医疗服务的内容；⑧法律、行政法规规定不得含有的其他内容。